下列哪项不是扁平苔藓的病理变化
A. 上皮增生或萎缩
B. 上皮棘层松解
C. 上皮基底细胞液化
D. 上皮钉突增生呈锯齿状
E. 上皮下淋巴细胞呈带状浸润

正确答案：B。上皮棘层松解

解析：扁平苔藓是一种皮肤黏膜病，大约有44%的扁平苔藓患者伴有口腔黏膜病变，但口腔黏膜单独发病者也不少见。口腔扁平苔藓临床上主要表现为黏膜的白色或灰白色网状或线状条纹；舌黏膜主要表现为浅白色斑块。镜下所见：在黏膜的白色条纹处，上皮有不全角化层；在黏膜发红区则无上皮角化。棘层增生者较多，也可见棘层萎缩。上皮钉突不规则延长，少数钉突尖端变成锯齿状。基底细胞层液化变性，因此基底细胞排列紊乱，基底膜界限不清，液化明显者可出现上皮下疱。固有层见淋巴细胞浸润带，浸润范围一般不达到黏膜下层。在上皮的棘层、基底层或固有层可见胶样小体或称Civatte小体，呈圆形或卵圆形，平均直径为10μm，为均质嗜酸性，PAS染色阳性。其来源可能是变性的上皮细胞。天疱疮最主要的病理变化是棘层松解。掌握“口腔扁平苔藓与慢性盘状红斑狼疮”知识点。